属于脑卒中不可控制的危险因素
A. 吸烟
B. 酗酒
C. 肿瘤
D. 紧张压力
E. 社会经济状况

正确答案：E。社会经济状况